为查明某病或某些疾病在某个国家或某个地区的现患情况或流行强度，大多使用
A. 群组研究
B. 抽样调查
C. 捷径调查
D. 病例-对照研究
E. 描述性流行病学

正确答案：B。抽样调查

解析：为查明某病或某些疾病在某个国家或某个地区的现患情况或流行强度，大多使用抽样调查的方法。掌握“口腔健康状况调查的目的、项目、标准及方法”知识点。